骨囊肿好发于
A. 长管状骨干骺端
B. 扁骨骨端
C. 长管状骨骨端
D. 短状骨骨端
E. 短骨干骺端

正确答案：A。长管状骨干骺端

解析：骨囊肿好发于长管状骨干骺端（A对C错）。扁骨骨端（B错）如颅骨、肋骨骨端是骨嗜酸性肉芽肿（P780）的好发部位；短状骨骨端（D错）、短骨干骺端（E错）为软骨瘤的好发部位。